将人工材料制作的牙根种植在牙槽内的手术是
A. 自体牙移植术
B. 异体牙移植术
C. 即刻再植
D. 延期再植
E. 牙种植术

正确答案：E。牙种植术

解析：牙种植术是指将人工材料制作的牙根种植在牙槽内的手术。掌握“牙槽外科”知识点。